跨过腹主动脉前方走行的是
A. 左肾静脉
B. 右肾静脉
C. 肝静脉
D. 肠系膜下静脉
E. 下腔静脉

正确答案：A。左肾静脉

解析：左肾静脉（A对）跨过腹主动脉前方走行，其长度比右肾静脉长。